男，34岁，咯鲜血半小时，就诊时仍有鲜血咯出。咳嗽不显著，无咳痰及呼吸困难。既往有类似情况出现，可自行停止，否认慢性心肺疾病史。查体：双肺呼吸音清晰。胸部X线片未见异常。为明确诊断，首先应进行的检查是
A. 上呼吸道检查
B. 支气管镜
C. 支气管动脉造影
D. 胸部CT
E. 肺动脉造影

正确答案：D。胸部CT

解析：患者为中年男性，既往出现咯血的症状，咳嗽不显著，无咳痰及呼吸困难，无慢性心肺疾病史，双肺呼吸音清晰，胸部X线片未见异常，考虑诊断为干性支气管扩张的早期（干性支气管扩张的症状为反复咯血）。支气管扩张症首选检查为胸部CT（D对），可清楚显示囊状扩张的支气管。支气管动脉造影（C错）为过去诊断支气管扩张症的金标准，但由于其为有创检查，且操作繁琐，已被HRCT所取代。上呼吸道检查（A错）、支气管镜（B错）、肺动脉造影（E错）可作为支气管扩张诊断的辅助检查，但特异性不高，不作为首选。